下列关于口底癌的生物学特性，正确的是
A. 常早期发生淋巴结转移
B. 常发生双侧颈淋巴结转移
C. 淋巴结转移转移率仅次于舌癌
D. 一般先有下颌下区转移，以后转移到颈深淋巴结
E. 以上都正确

正确答案：E。以上都正确

解析：口底癌常早期发生淋巴结转移，转移率仅次于舌癌，一般转移至颏下、下颌下及颈深淋巴结，但大都先有下颌下区转移，以后转移到颈深淋巴结，并常发生双侧颈淋巴结转移。掌握“颊癌、口底癌及唇癌”知识点。